慢性镉中毒的叙述中错误的是
A. 患者均为多子女的妇女
B. 妊娠、哺乳、营养不良等是发病的诱因
C. 不同地区慢性镉中毒患者的临床表现相同
D. 尿镉主要与体内镉负荷量及肾镉浓度有关
E. 痛痛病是慢性镉中毒的典型案例

正确答案：C。不同地区慢性镉中毒患者的临床表现相同

解析：本题考查慢性镉中毒。慢性镉中毒是人群长期暴露于受镉污染的环境，主要是水体与土壤镉污染和由此导致的稻米与鱼贝类食物镉含量增高，造成摄入者体内镉蓄积并超过一定阈值所引起的以肾脏和骨骼损伤为主要中毒表现的环境污染性疾病。痛痛病是慢性镉中毒的典型案例（E对）。不同地区慢性镉中毒患者的临床表现特征有一定的差别（C错，为本题正确答案），如在日本痛痛病地区，慢性镉中毒患者有明显的骨软化症。患者疼痛难忍，卧床不起，呼吸受限，最后往往死于其他合并症。慢性镉中毒患者多为40岁以上的妇女，如多子女的妇女（A对），妊娠、哺乳、营养不良等是发病的诱因（B对）。尿镉主要与体内镉负荷量及肾镉浓度有关（D对），可用作镉暴露和吸收的生物标志物。